关于启动子的叙述下列哪项正确
A. 开始被翻译的DNA序列
B. 开始转录生成mRNA的DNA序列
C. 开始结合RNA聚合酶的DNA序列
D. 阻遇蛋白结合的DNA序列
E. 产生阻遏物的基因

正确答案：C。开始结合RNA聚合酶的DNA序列